外邪由皮毛传入脏腑的途径，依次是
A. 络脉—孙脉—经脉
B. 孙脉—经脉—络脉
C. 经脉—孙脉—络脉
D. 络脉—经脉—孙脉
E. 孙脉—络脉—经脉

正确答案：E。孙脉—络脉—经脉

解析：外邪侵犯人体由表及里，先从皮毛开始。卫气充实于络脉，络脉散布于全身，密布于皮部，当外邪侵犯机体时，卫气首当其冲发挥其抗御外邪、保卫机体的屏障作用。人体由表入里为孙脉、络脉、经脉，故外邪由皮毛传入脏腑的途径依次为孙脉一络脉一经脉（E对）。